对于3岁以下儿童股骨干骨折的治疗，正确的叙述是
A. 可以接受骨折断端有2cm以内的缩短
B. 常采用切开复位内固定治疗
C. 常采用骨牵引治疗
D. 可以接受轻度的旋转移位
E. 应与成人骨折的治疗原则一致

正确答案：A。可以接受骨折断端有2cm以内的缩短

解析：股骨干骨折的功能复位标准：缩短移位在成人不应超过1cm；儿童若无骨骺损伤，下肢缩短在2cm以内，在生长发育过程中可自行矫正，即可接受骨折断端有2cm以内的缩短（A对）；对于旋转骨折必须完全矫正（D错）。股骨干骨折儿童多采用手法复位，3岁以下儿童常采用垂直悬吊皮肤牵引，成人常采用骨牵引（C错），故儿童与成人骨折的治疗原则不一致（E错）。切开复位内固定（B错）多为成人手术治疗方法。